牙体缺损修复过程中，可能导致牙髓损害的因素不包括
A. 牙体制备
B. 灌模型
C. 戴临时冠
D. 预备体消毒
E. 取印模

正确答案：B。灌模型

解析：灌模型是在口外进行的工作，与患者无接触，因此不可能会再对牙髓造成影响。掌握“牙体缺损修复治疗原则”知识点。